某男，24岁，有不洁性接触史，因近2日尿急、尿频、排尿刺痛而来院就诊。查体尿道口有白色脓性分泌物。分泌物涂片染色，镜下见到革兰阴性成双排列的球菌，试问，该患感染可能是由下述哪种细菌引起
A. 肺炎链球菌
B. 淋病奈瑟菌
C. 葡萄球菌
D. 链球菌
E. 脑膜炎奈瑟菌

正确答案：B。淋病奈瑟菌